女，36岁。腹泻伴纳差、乏力、消瘦、发热5月余，大便为黄色糊状，3～5次/日。下列辅助检查最有明确诊断的是
A. 结肠镜及活检
B. 消化道造影
C. 肿瘤标记物检查
D. 血沉
E. 粪便检查

正确答案：A。结肠镜及活检

解析：中年女性患者，纳差、乏力、消瘦、发热（结核毒血症状）伴腹泻5月余，粪便呈糊样（符合溃疡型肠结核的表现），疑诊为肠结核。对诊断最有意义的检查是结肠镜及活检（A对），若发现肉芽肿、干酪坏死或抗酸杆菌即可诊断为肠结核。消化道造影（B错）可发现跳跃征、溃疡、肠管变形和肠腔狭窄等征象，是诊断肠结核的次选检查，效果逊于结肠镜。肿瘤标记物检查（C错）是诊断结直肠癌的敏感性指标（八版内科学P396）。血沉（D错）增高可见于多种疾病，如急性炎症、白血病、结缔组织病及结核病的活动期，不具有特异性，不用于确诊肠结核。粪便中查到结核杆菌（E错）仅表明肠道内含有结核杆菌，可能由肺结核患者吞咽下结核杆菌引起。